三叉丘系损伤后出现
A. 对侧咀嚼肌瘫痪
B. 对侧眼裂以下的面肌瘫痪
C. 同侧头面部痛温觉消失
D. 对侧头面部痛温觉消失
E. 对侧面肌瘫痪

正确答案：C。同侧头面部痛温觉消失

解析：参与头面部的痛温觉和触压觉传导通路若三叉丘脑束以上受损，则导致对侧头面部痛温觉和触压觉障碍（D错）；若三叉丘脑束以下受损，则同侧头面部痛温觉消失（C对）。